气滞可见
A. 闷胀疼痛
B. 面红目赤
C. 少腹胀满重坠
D. 突然昏厥，不省人事
E. 汗出不止

正确答案：A。闷胀疼痛

解析：气滞于某一经络或局部，可出现相应部位的胀满、疼痛（A对）；气逆常见于肺胃肝等脏腑，肝气上逆者，表现为头痛头胀、面红目赤、易怒等症（B错）；气陷的形成，多由气虚发展而来，与脾气不升关系最为密切，常伴有面色无华，气短乏力，语声低微，脉弱无力，以及腰腹胀满重坠、便意频频等症（C错）；气闭的形成，多由情志刺激，或外邪、痰浊等闭塞气机，使气不得外出而闭塞清窍所致，其发病多急骤，以突然昏厥，不省人事为特点（D错）；气脱指气不内守，大量向外脱失，以致机体功能突然衰竭的病机变化，临床表现为面色苍白，汗出不止，目闭口开，全身瘫软，手撒，二便失禁，脉微欲绝或虚大无根等症状（E错）。